胁肋胀闷，脘腹疼痛，手足不温，脉弦者治宜选用
A. 一贯煎
B. 痛泻要方
C. 四逆散
D. 柴胡疏肝散
E. 逍遥散

正确答案：C。四逆散

解析：四逆散方含柴胡（君药）、白芍（臣药）、枳实（佐药）、炙甘草（佐使药），可透邪解郁，疏肝理脾（调和肝脾），主治阳郁厥逆证（手足不温，或腹痛，或泄利下重，脉弦）或肝脾不调证（胁肋胀痛，脘腹疼痛，脉弦）（C对）。一贯煎功用滋阴疏肝，主治肝肾阴虚，肝气郁滞证（A错）。痛泻要方功用补脾柔肝，祛湿止泻，主治脾虚肝郁之痛泻（B错）。柴胡疏肝散功用疏肝解郁，行气止痛，主治肝气郁滞证（D错）。逍遥散功效疏肝解郁，养血健脾，主治肝郁血虚脾弱证（E错）。